儿茶的功效是
A. 清心除烦
B. 清肺化痰
C. 清肝明目
D. 清胃止呕
E. 清肠疗痔

正确答案：B。清肺化痰

解析：本题考查儿茶的功效。儿茶的功效是清肺化痰（B对）。儿茶【功效】收湿敛疮，生肌止血，活血止痛，清肺化痰。灯心草【功效】利尿通淋，清心除烦（A错）。夏枯草【功效】清肝明目（C错），散结消肿。芦根【功效】清热生津，除烦止呕（D错），利尿。马兜铃【功效】清肺化痰，止咳平喘，清肠疗痔（E错）。